临床上义齿的支持、固位和稳定均好，修复效果最佳的为哪种义齿类型
A. 金属铸造支架式义齿
B. 黏膜支持式义齿
C. 牙与黏膜混合支持式义齿
D. 胶连式义齿
E. 牙支持式义齿

正确答案：E。牙支持式义齿

解析：牙支持式义齿：适用于少数牙缺失，或缺牙间隙小，缺隙两端均有基牙，且基牙稳固者。义齿的支持、固位和稳定均好，修复效果最佳。掌握“局部义齿类型，肯氏分类及模型观测”知识点。